下列哪一项是识别和确认职业性致癌因素的最终方法
A. 临床表现
B. 临床体征
C. 理化检验
D. 实验研究
E. 人群流行病学调查

正确答案：E。人群流行病学调查